苯二氮䓬类镇静催眠药中毒的特异性解救药是
A. 碳酸氢钠
B. 高锰酸钾
C. 氟马西尼
D. 青霉胺
E. 纳洛酮

正确答案：C。氟马西尼

解析：本题考查苯二氮䓬类镇静催眠药中毒解救。苯二氮䓬类镇静催眠药中毒的特异性解救药是氟马西尼（C对）。氟马西尼是特异性苯二氮䓬受体阻断剂，能快速逆转昏迷，首次静脉注射剂量为0.3mg。碳酸氢钠（A错）用于巴比妥类镇静催眠药急性中毒的解救。高锰酸钾（B错）常用于巴比妥类、阿片类、士的宁等中毒时的洗胃。青霉胺（D错）用于铜、汞、铅中毒的解救。纳洛酮（E错）用于阿片类药物中毒的解救。